可以导致第八对脑神经损害的药物是
A. 青霉素
B. 链霉素
C. A和B均是
D. A和B均不是

正确答案：B。链霉素

解析：本题考查氨基糖苷类抗生素。链霉素（B对）能够导致第八对脑神经损害，这是氨基苷类典型的毒性反应；青霉素（ACD错）典型不良反应为过敏反应。